男，60岁。因肝硬化一次排放腹水3000ml而无尿，诊断应首先考虑为
A. 急性肝衰竭
B. 急性心衰
C. 肾前性肾衰竭
D. 肾后性肾衰竭
E. 肾性肾衰竭

正确答案：C。肾前性肾衰竭

解析：肝硬化患者由于严重门静脉高压，内脏高动力循环使体循环血流量明显减少；多种扩血管物质如前列腺素、一氧化氮等不能被肝脏灭活，引起体循环血管床扩张，肾脏血流灌注不足，因此易出现肾前性肾衰竭（肾前性肾衰竭由肾脏血流灌注不足所致）。患者一次排放腹水3000ml，使体循环血流量进一步减少而无尿，考虑诊断为肾前性肾衰竭（C对）。肾后性肾衰竭（D错）常由尿路梗阻所致。肾性肾衰竭（E错）常由缺血和肾毒性物质所致。急性肝衰竭（九版外科学P88-P89）（A错）为急性起病，主要表现为意识障碍、肝臭、出血等，一般不会出现无尿；急性心衰（P174-P175）（B错）主要表现为突发严重呼吸困难、频繁咳嗽，咳粉红色泡沫状痰。